脊髓内交感神经的节前神经元胞体位于
A. 第3颈椎
B. 中间内侧核
C. 中间核
D. 骶外侧核
E. 中间外侧核

正确答案：E。中间外侧核

解析：脊髓内交感神经的节前神经元胞体位于脊髓中间外侧核（E对）。